下列不属于社区的要素的选项是
A. 社区居委会
B. 某一时段
C. 居民的健康观念
D. 健康保险制度
E. 某地域

正确答案：B。某一时段

解析：本题考查社区的要素。社区的要素主要包括6个方面：①一定数量的人群（A对）；②一定范围的地理空间（E对）；③社区内的各种服务设施；④特定的精神、文化氛围或背景；⑤相应的管理机构和制度（D对）；⑥一定程度的归属感与社区认同（C对）。某一时段（B错，为本题正确答案）不属于社区的要素。